二级靶向制剂系指
A. 进入靶器官释药的制剂
B. 进入靶组织释药的制剂
C. 进入靶部位的毛细血管床释药的制剂
D. 进入靶部位的特殊细胞释药的制剂
E. 药物作用于细胞内的一定部位的制剂

正确答案：D。进入靶部位的特殊细胞释药的制剂

解析：本题考查的是靶向制剂的分类。二级靶向制剂系指进入靶部位的特殊细胞释药的制剂（D对）。靶向制剂系指药物与载体结合或被载体包裹能将药物直接定位于靶区，或给药后药物集结于靶区，使靶区药物浓度高于正常组织的给药体系。靶向制剂可使药物浓集于靶组织（B错）、靶器官（A错）、靶细胞及其周围，提高疗效并显著降低对其他组织、器官及全身的毒副作用。按靶向的部位，靶向制剂可分为如下几种。一级靶向制剂：系指进入靶部位的毛细血管床释药（C错）。二级靶向制剂：系指进入靶部位的特殊细胞（如肿瘤细胞）释药，而不作用于正常细胞。三级靶向制剂：系指药物作用于细胞内的一定部位（E错）。